为了减少基牙的负担，应增加哪个间隙
A. 颊侧外展隙
B. 舌外展隙
C. （牙合）外展隙
D. 邻间隙
E. 切外展隙

正确答案：B。舌外展隙

解析：本题考查桥体的（牙合）面设计。为了减少基牙的负担，应加大舌外间隙（B对）。减小（牙合）力，减轻基牙负担的措施除了减小桥体的颊舌径外，还可以加大桥体与固位体之间的舌外展隙，增加食物的溢出道，减小（牙合）面的牙尖斜度等。